按《中国药典》规定，质量控制成分的结构类型为异喹啉类生物碱的药材是
A. 川乌
B. 天仙子
C. 防己
D. 马钱子
E. 千里光

正确答案：C。防己

解析：本题考查的是防己的化学成分。按《中国药典》规定，质量控制成分的结构类型为异喹啉类生物碱的药材是防己（C对）。防己的有效成分为生物碱，总生物碱含量可达2.3%～5%，其中汉防己甲素（粉防己碱）约为1%，汉防己乙素（防己诺林碱）约为0.5%。汉防己甲素与汉防己乙素为异喹啉类生物碱。《中国药典》以粉防己碱和防己诺林碱为指标成分进行含量测定，对药材要求两者总量不得少于1.6%；对饮片要求两者总量不得少于1.4%。汉防己甲素和汉防己乙素属于双苄基异喹啉类生物碱。川乌（A错）的含量测定成分为二萜类生物碱。乌头和附子主要含二萜类生物碱，属于四环或五环二萜类衍生物。乌头生物碱的结构复杂、结构类型多。其重要和含量较高的有乌头碱、次乌头碱和新乌头碱。《中国药典》以三者为指标成分进行含量测定，要求三者总量应为0.050～0.17%。天仙子（B错）的含量测定成分为莨菪烷类生物碱。天仙子主要的生物碱有莨菪碱和东莨菪碱等。《中国药典》以东莨菪碱和莨菪碱为指标成分进行含量测定，要求两者总量不得少于0.080%。马钱子（D错）的含量测定成分为单萜吲哚类生物碱。马钱子成熟种子中生物碱含量为1.5%～5%，主要生物碱是士的宁（又称番木鳖碱）、马钱子碱及其氮氧化物，还含少量的10余种其他吲哚类生物碱，其中以士的宁含量居首，占总碱量的35%～50%，其次是马钱子碱，占总碱量的30%～40%。《中国药典》以士的宁和马钱子碱为指标成分进行含量测定，要求士的宁的含量应为1.20%～2.20%，马钱子碱的含量不得少于0.80%。千里光（E错）的含量测定成分为吡咯里西啶类生物碱。千里光中所含有的生物碱主要为吡咯里西啶类生物碱，主要化学成分有千里光宁碱、千里光菲宁碱及痕量的阿多尼弗林碱等；同时含有黄酮苷等成分。《中国药典》以阿多尼弗林碱为指标成分进行限量测定，其中阿多尼弗林碱的含量不得过0.004%。